经过检测，某食物每百克视黄醇当量为310μg，能量138kcal。现已知推荐的每日膳食中营养素供给量，成年轻体力劳动者视黄醇当量为800μg，能量为2600kcal。营养素密度为
A. 5.373×10⁻³
B. 0.2219
C. 0.3875
D. 0.5373
E. 2.5806

正确答案：C。0.3875